囊腔内可含有发育不同阶段的牙
A. 含牙囊肿
B. 残余囊肿
C. 正中囊肿
D. 球上颌囊肿
E. 鼻腭管囊肿

正确答案：A。含牙囊肿

解析：本题考查含牙囊肿。囊腔内可含有发育不同阶段的牙为含牙囊肿（A对）。含牙囊肿：颌骨中边缘光滑的类圆形透射影，边缘光滑，囊腔内可含有发育不同阶段的牙，牙冠朝向囊腔，囊壁通常连于牙冠与牙根交界处。单房多见。